小儿原发型肺结核出现类似百日咳样痉挛性咳嗽是由于胸内淋巴结肿大，压迫
A. 气管
B. 气管分叉处
C. 支气管
D. 细支气管
E. 喉返神经

正确答案：B。气管分叉处

解析：胸内淋巴结高度肿大时可产生一系列压迫症状：压迫气管分叉处可出现类似百日咳样痉挛性咳嗽（B对），压迫支气管使其部分阻塞可引起喘鸣（C错），压迫喉返神经可致声嘶（E错），压迫静脉可致胸部一侧或双侧静脉怒张。